下列可出现原位溶血的疾病是
A. 遗传性球形细胞增多症
B. G6PD缺乏症
C. 骨髓增生异常综合征
D. 异常血红蛋白病
E. 阵发性睡眠性血红蛋白尿

正确答案：C。骨髓增生异常综合征

解析：无效性红细胞生成或原位溶血，指骨髓内的幼红细胞在释入血液循环之前已在骨髓内破坏，本质是一种血管外溶血。骨髓增生异常综合征（C对）时，造血细胞在骨髓中分化成熟障碍，出现病态造血，幼红细胞在骨髓原位或释放入血后不久即被破坏，可发生原位溶血。遗传性球形细胞增多症（P553）（A错）时，红细胞变形性和柔韧性降低，红细胞表面积与体积之比降低，渗透脆性增加，当通过脾脏等单核-巨噬细胞系统时易被破坏，出现血管外溶血，红细胞的破坏主要发生在骨髓外；G6PD缺乏症（P554）（B错）时，由于缺乏葡萄糖-6-磷酸脱氢酶导致红细胞不能抵抗氧化剂对细胞膜产生氧化损伤，红细胞易于被脾脏巨噬细胞吞噬发生血管外溶血，也可发生血管内溶血；异常血红蛋白病（P556-P557）（D错）红细胞变形性差，膜通透性增加，易于在脾脏中破坏，发生血管外溶血，或因红细胞机械脆性增高，发生血管内溶血；阵发性睡眠性血红蛋白尿（P559）（E错）时，红细胞膜缺陷，易被补体破坏而发生血管内溶血。